多见于体弱、心肺慢性疾病患者院内获得性感染的是
A. 干酪性肺炎
B. 葡萄球菌肺炎
C. 革兰阴性杆菌肺炎
D. 急性肺脓肿
E. 肺癌

正确答案：C。革兰阴性杆菌肺炎

解析：医院获得性肺炎是指患者入院时不存在，也不处于潜伏期，而于入院48小时后在医院内发生的肺炎。革兰氏阴性杆菌（铜绿，肠杆）（占50-70％）金葡菌11-25％ ，选革兰氏阴性菌（C对B错）。干酪性肺炎（P68）（A错）多与住院无关，多发生在机体免疫力和体质衰弱，又受到大量结核分支杆菌感染的患者，或有淋巴结支气管瘘，淋巴结中的大量干酪样物质经支气管进入肺内发生。急性肺脓肿（D错）见于免疫力正常的患者，感染局限形成脓肿。肺癌（E错）是一种与遗传、环境等各种因素有关的异质性疾病，而不是由感染引起的。